流行性乙型脑炎（简称乙脑）的主要传染源是
A. 猪
B. 乙脑病毒携带者
C. 乙脑患者
D. 蚊虫
E. 野鼠

正确答案：A。猪